金黄散主要适用于
A. 阳证溃疡
B. 阴证溃疡
C. 溃后生肌
D. 半阴半阳证
E. 阳证疮疡

正确答案：E。阳证疮疡

解析：金黄散可清热除湿，散瘀化痰，止痛消肿，可用于红肿热痛明显的阳证疮疡（E对）。溃疡阳证可选用月白珍珠散、拔毒生肌散（A错）。溃疡阴证多选用回阳玉龙散（B错）。溃后生肌可选用生肌白玉膏（C错）。半阴半阳证则可选用冲和散（D错）。